女，24岁。足月妊娠临产10小时，宫口扩张2cm，自觉下腹部持续疼痛，孕妇烦躁不安，疼痛喊叫，宫缩频率高，子宫下段收缩最强。此时应首选的措施是
A. 静滴缩宫素
B. 行剖宫产
C. 肌注哌替啶
D. 人工破膜
E. 无需任何处理

正确答案：C。肌注哌替啶

解析：该患者足月妊娠临产10小时，宫口扩张2cm，自觉下腹部持续疼痛，孕妇烦躁不安，疼痛喊叫，宫缩频率高，子宫下段收缩最强（（不协调性宫缩乏力的子宫收缩波小而不规律，频率高，节律不协调，宫缩时宫底部不强，而是子宫下段强，产妇自觉下腹部持续疼痛、拒按，烦躁不安）），患者初步诊断是不协调性宫缩乏力。不协调性宫缩乏力的处理原则是调节子宫收缩，恢复正常节律性和极性。首选的措施是肌注哌替啶（P190）（C对E错），使产妇充分休息，醒后不协调性宫缩多能恢复为协调性宫缩。人工破膜（P189）（D错）适用于宫口≥3cm、无头盆不称、胎头已衔接而产程延缓者。静滴缩宫素（P189）（A错）适用于协调性宫缩乏力、宫口扩张≥3cm、胎心良好、胎位正常、头盆不称者。不协调性宫缩乏力可以通过调节子宫收缩，恢复正常节律性和极性，不需行剖宫产（B错）。